腹痛病因病机与下列何项无关
A. 外感时邪
B. 饮食不节
C. 情志失调
D. 阳气素虚
E. 年高体虚

正确答案：E。年高体虚

解析：腹痛的病因多为感受外邪、饮食所伤、情志失调及素体虚弱、劳倦内伤等,致气机脉络痹阻或经脉失养而发生腹痛（E错，为本题正确答案）。